磺胺类药物能与相应的酶竞争结合抑制细菌，发挥对多种细菌有抑制作用，是由于磺胺类药物类似于
A. 三氢叶酸
B. 二氢叶酸
C. 嘧啶
D. 叶酸
E. 对氨基苯甲酸

正确答案：E。对氨基苯甲酸

解析：磺胺类药物对多种细菌有抑制作用。这是因为细菌的生长繁殖有赖于核酸的合成，而磺胺药的结构与核酸合成时所需的四氢叶酸中的对氨基苯甲酸结构相似性，因而能与相应的酶竞争结合，抑制细菌。掌握“辅酶与酶促反应”知识点。